体循环起、止于
A. 左心室至右心房
B. 右心室至左心房
C. 主动脉至肺动脉
D. 左心房至左心室
E. 右心房至右心室

正确答案：A。左心室至右心房

解析：起自左心室止于右心房（A对）的循环途径为体循环。体循环和肺循环同时进行，体循环的路程长，流经范围广，以动脉血滋养全身各部，并将全身各部的代谢产物和三氧化碳运回心。